治疗饮食伤胃型胃痛，除主穴外，还应加用
A. 三阴交、胃俞
B. 膈俞、膻中
C. 胃俞、脾俞
D. 天枢、梁门
E. 气海、关元

正确答案：D。天枢、梁门

解析：针对不同证型的胃痛治疗，当根据病因循经取穴。饮食伤胃型胃痛，除选择治疗胃痛的主穴外，当配以与脾、胃相关的腧穴。天枢与梁门配合可治疗饮食伤胃型胃痛（D对）。三阴交配胃俞可用于治疗胃阴不足型胃痛（A错）；膈俞、膻中可治疗气滞血瘀型胃痛（B错）；胃俞、脾俞加神阙可治疗脾胃虚寒型胃痛（C错）。气海为任脉腧穴，可用于治疗虚脱、腹泻、小便不利、遗精、月经不调等证；关元也为任脉腧穴，可用于治疗中风脱证、少腹疼痛、腹泻、五淋、遗精、月经不调等证（E错）。